下述哪个不属于眼球中膜的结构
A. 巩膜静脉窦
B. 脉络膜
C. 虹膜
D. 睫状体
E. 瞳孔开大肌

正确答案：A。巩膜静脉窦

解析：眼球从外向内依次分为眼球纤维膜、血管膜和视网膜3层，其血管膜即为眼球中膜。眼球血管膜由前至后又可分为虹膜（C对）、睫状体（D对）和脉络膜（B对）3部分，且虹膜内含有瞳孔开大肌（E对），故脉络膜、虹膜、睫状体和瞳孔开大肌是眼球中膜的结构。巩膜静脉窦（A错，为本题正确答案）在靠近角膜缘处的巩膜实质内，故不属于眼球中膜结构。